男，42岁，呕吐、腹泻两天，意识模糊、烦躁不安半天急诊入院。查体：BP110/70mmHg，神志恍惚，巩膜中度黄染，颈部可见数枚蜘蛛痣，心肺未见异常，腹软，肝肋下未触及，脾肋下3cm，双上肢散在出血点，Hb90g/L，WBC3.2×10⁹/L，血糖7.0mmol/L，尿糖（+），尿酮（-）尿镜检（-）。最可能的诊断是
A. 肝性脑病
B. 糖尿病酮症酸中毒
C. 高渗性非酮症糖尿病昏迷
D. 尿毒症
E. 脑血管病

正确答案：A。肝性脑病

解析：中年男性患者，巩膜中度黄染、颈部可见数枚蜘蛛痣、双上肢散在出血点（肝功能减退的表现），脾肋下3cm（脾肿大，门静脉高压的表现），提示患者有肝硬化。患者呕吐、腹泻两天（肝硬化引起肝性脑病的诱因），意识模糊、烦躁不安（肝性脑病的表现）半天。综合患者的病史、临床表现、查体检查，最可能的诊断是肝性脑病（A对）。糖尿病酮症酸中毒（B错）常有糖尿病病史，血糖增高（一般为16.7～33.3mmol/L，有时可达55.5mmol/L以上）、尿糖强阳性和尿酮阳性。高渗性非酮症糖尿病昏迷（C错）常见于糖尿病患者，血糖常>33.3mmol/L，血浆渗透压增高（一般为320～430Osm/L）。尿毒症（D错）多有长期肾脏病史，尿镜检阳性。脑血管病（E错）常见于老年患者，多有高血压、高血脂等病史，常伴四肢偏瘫。